关于平喘药物的作用，哪项错误
A. 稳定肥大细胞膜
B. β₂受体激动
C. 磷酸二酯酶抑制
D. M受体阻断
E. H₂受体阻断

正确答案：E。H₂受体阻断